分泌胰岛素的细胞是
A. ξ细胞
B. PP细胞
C. α细胞
D. β细胞
E. 导管细胞

正确答案：D。β细胞

解析：胰岛属于胰腺内分泌部分，包括有多种细胞，以β细胞（D对）为主，分泌胰岛素；其次是α细胞（C错）分泌胰高血糖素，以及δ细胞（A错）分泌生长抑素；还有少数PP细胞（B错）分泌胰多肽、G细胞分泌促胃液素和D1细胞分泌血管活性肠肽（九版外科学P457）。导管细胞（E错）为胰腺外分泌腺导出胰液部分。